患者，男，73岁，胃溃疡病史2年，半年前出现静止性震颤搓丸样，运动迟缓，面具脸，慌张步态，该患者应使用的药物是
A. 多奈哌齐
B. 甲基多巴
C. 多巴丝肼(苄丝肼左旋多巴）
D. 司来吉兰
E. 苯海索

正确答案：C。多巴丝肼(苄丝肼左旋多巴）

解析：本题考查多巴丝肼。出现题干所述症状的患者应该使用的药物是多巴丝肼(苄丝肼左旋多巴）（C对）。静止性震颤搓丸样，运动迟缓，面具脸，慌张步态属于帕金森病的临床表现，多巴丝肼(苄丝肼-左旋多巴）用于治疗各种类型的帕金森病。多奈哌齐（A错）用于轻度或中度阿尔茨海默病症状的治疗。甲基多巴（B错）用于高血压。司来吉兰（D错）单用治疗早期帕金森病，也可与左旋多巴或左旋多巴或外周多巴脱羧酶抑制剂合用，但是该患者有胃溃疡病史，有消化性溃疡以及病史者禁用司来吉兰。苯海索（E错）可用于帕金森病、帕金森综合征，但是老年人长期应用容易促发青光眼。